患者，女，45岁。突发身目发黄，黄色鲜明，右胁胀闷疼痛，牵引肩背，寒热往来，口苦咽干，尿黄便秘，舌红苔黄，脉弦滑数。其证候是
A. 热重于湿
B. 湿重于热
C. 疫毒炽盛
D. 胆腑郁热
E. 脾虚湿滞

正确答案：D。胆腑郁热

解析：题中患者身目发黄，诊断为黄疸；黄色鲜明，口苦咽干，舌红苔黄，脉弦滑数，故诊断为阳黄。湿邪壅阻中焦，肝气郁滞，疏泄不利，则右胁胀闷疼痛，牵引肩背；湿热留恋，伏而不解，三焦气化失司，脾胃不和，肝胆失疏，则寒热往来，口苦咽干，舌红苔黄，脉弦滑数；湿邪阻遏下焦，胆汁疏泄失常，下注膀胱，则尿黄便秘，故为胆腑郁热证的表现（D对）。热重于湿证之阳黄的主要临床表现为身目俱黄，黄色鲜明，发热口渴，或见心中懊恼，腹部胀闷，口干而苦，小便短少黄赤，大便秘结等（A错）。湿重于热之阳黄的主要临床表现为身目俱黄，黄色不及前者鲜明，头重身困，胸脘痞满，食欲减退，恶心呕吐，腹胀或大便溏垢等（B错）。疫毒炽盛之阳黄的主要临床表现为发病急骤，黄疸迅速加深，其色如金，皮肤瘙痒，高热口渴，胁痛腹满，神昏谵语，烦躁抽搐，或见衄血、便血，或肌肤瘀斑等（C错）。脾虚湿滞之阴黄的主要临床表现为面目及肌肤淡黄，甚则晦暗不泽，肢软乏力，心悸气短，大便溏薄等（E错）。